催眠量巴比妥类醒后出现眩晕、困倦、精细运动不协调
A. 变态反应
B. 后遗效应
C. 毒性反应
D. 特异质反应
E. 副作用

正确答案：B。后遗效应